可以作为不溶性骨架材料的是
A. Ⅱ号、Ⅲ号丙烯酸树脂
B. 羟丙甲纤维素
C. 硅橡胶
D. 离子交换树脂
E. 鞣酸

正确答案：C。硅橡胶

解析：本题考查不溶性高分子材料。不溶性骨架材料是指不溶于水或水溶性极小的高分子聚合物或无毒塑料等。常用的有乙基纤维素（EC）、聚乙烯、无毒聚氯乙烯、乙烯-醋酸乙烯共聚物、硅橡胶（C对）等。Ⅱ号、Ⅲ号丙烯酸树脂（A错）为肠溶包衣材料。羟丙甲纤维素（B错）为亲水性凝胶骨架材料。离子交换树脂（D错）是带有离子交换基团的不溶性高分子化合物。鞣酸（E错）是一种鞣质，大量用于制造蓝墨水。